一名患者，诊断为逆行性牙髓炎，决定其预后的最关键因素为
A. 患者的年龄
B. 患者的全身状况
C. 牙髓治疗的疗效
D. 口腔卫生习惯
E. 牙周的病变程度及预后

正确答案：E。牙周的病变程度及预后

解析：一名患者，诊断为逆行性牙髓炎，决定其预后的最关键因素为牙周的病变程度及预后（E对）。逆行性牙髓炎的患牙能否保留，主要取决于该牙牙周病变的程度和牙周治疗的效果。如果牙周袋能消除或变浅，病变能得到控制，则可先作牙髓治疗，同时开始牙周炎的序列治疗；如果多根牙只有一个牙根有深牙周袋引起的牙髓炎，且患牙不太松动，则可在根管治疗和牙周炎症控制后，将患根截除，保留患牙；如牙周病变已十分严重，不易彻底控制炎症，或患牙过于松动，则可直接拔牙止痛。患者的年龄（A错）、全身情况（B错）、牙髓治疗的疗效（C错）及口腔卫生习惯（D错）可能会影响预后，但关键是牙周病变的程度及预后，只要牙周破坏不太严重，牙齿不太松动，治疗和保存患牙的机会较高。